移码突变
A. 碱基对的缺失与插入
B. 不等于3的倍数的碱基对的缺失与插入
C. DNA链的大段缺失与插入
D. 三联密码的缺失与插入
E. 染色体的缺失与插入

正确答案：B。不等于3的倍数的碱基对的缺失与插入

解析：本题考查移码突变。移码突变指在DNA碱基序列中，插入或缺失一个或几个碱基（除了3或3的倍数）（B对ACDE错），于是按三联密码连续阅读的规则，该部位以后的密码子组成全部改变，指导合成的多肽链也全部发生改变。